面神经颊支损伤表现为
A. 下唇歪斜
B. 鼓腮障碍
C. 额纹消失
D. 眼睑不能闭合
E. 伸舌时偏向患侧

正确答案：B。鼓腮障碍

解析：本题考查面神经损伤。面神经颊支损伤表现为鼓腮障碍（B对）。面神经主干在进入腮腺会分为颞支、颧支、颊支、下颌缘支及颈支。下唇歪斜是面神经下颌缘支损伤时的表现（A错）。鼓腮障碍是面神经颊支损伤时的表现。额纹消失是面神经颞支损伤时的表现（C错）。眼睑不能闭合是面神经颧支损伤时的表现（D错）。伸舌时偏向患侧是舌下神经损伤时的表现（E错）。